男，35岁。高处坠落导致胸背部疼痛。下肢感觉障碍，5小时逐渐恢复。最可能的诊断是
A. 脊髓休克
B. 脊髓震荡
C. 脊髓损伤
D. 脊髓截断
E. 脊髓水肿

正确答案：B。脊髓震荡

解析：患者高处坠落后，胸背部疼痛，下肢感觉障碍（提示可能有脊髓损伤），5小时逐渐恢复，结合患者病史及临床表现，该患者最可能的诊断为脊髓震荡（B对）。脊髓休克（A错）是脊髓实质完全性横贯性损伤过程中的一个病理生理过程，并不能作为独立的诊断，表现为损伤平面以下感觉、运动功能完全丧失，后期因不同的损伤程度会遗留后遗症，脊髓震荡也是脊髓休克的原因之一。脊髓截断（D错）为严重的脊髓损伤，表现为损伤平面以下永久的感觉运动反射消失，不会自行恢复。脊髓水肿（E错）常见于外伤、脊椎病或者脊柱肿瘤，表现为脊髓平面以下的各种功能障碍、截瘫或不完全截瘫，不会在短期内恢复正常。脊髓损伤（C错）为一个大的笼统的概念，其他选项均属于脊髓损伤的一种类型，不是该题目最佳选项。